急性牙龈脓肿无哪项症状
A. 多数牙间乳头的红肿和跳痛
B. 患牙及邻牙均对叩诊敏感
C. 外周血白细胞计数升高
D. 口腔黏膜往往普遍红肿，出现溃疡和假膜
E. 体温升高，局部淋巴结肿大

正确答案：D。口腔黏膜往往普遍红肿，出现溃疡和假膜

解析：本题考查急性牙龈脓肿的症状。急性牙龈脓肿是由于异物刺入等局部刺激因素等导致的牙龈炎症，仅局限于龈乳头和龈缘炎，呈局限性肿胀，不会出现口腔黏膜普遍红肿、溃疡和假膜（D错，为本题正确答案）。局部症状为多数牙间乳头的红肿和跳痛（A对）、患牙及邻牙均对叩诊敏感（B对），这是由于炎症刺激导致牙周膜充血所致。另外，由于局部炎症刺激，可能出现全身反应，如外周血白细胞计数升高（C对）、体温升高，局部淋巴结肿大（E对）等。